男，重体力劳动工人。腰腿痛，向左下肢放射，咳嗽、喷嚏时加重1月。检查：腰部活动明显受限，并向左倾斜，直腿抬高试验阳性。病程中无低热盗汗消痩症状。如有小腿外侧及足背皮肤麻木，趾背伸无力，腱反射无改变，病变的节段应考虑是
A. 腰1～2
B. 腰2～3
C. 腰3～4
D. 腰4～5
E. 腰5～骶1

正确答案：D。腰4～5

解析：患者男性、重体力劳动工人，腰腿痛、向左下肢放射、咳嗽喷嚏时加重（腰椎间盘突出症典型表现），腰部活动明显受限、向左倾斜，直腿抬高试验阳性（腰椎间盘突出症的重要体征），结合患者症状和体征，该患者首先考虑的诊断是腰椎间盘突出症。患者有小腿外侧及足背皮肤麻木，趾背伸无力，腱反射无改变（L5受累表现），该患者病变的节段应考虑是腰4-5（D对）。腰1-2（A错）病变对应L2受累，表现为大腿前中部感觉减退，髂腰肌肌力减弱。腰2-3（B错）病变对应L3受累，表现为股骨内髁感觉减退，股四头肌肌力减弱，膝反射减弱或消失。腰3-4（C错）病变对应L4受累，表现为小腿前内侧麻木及伸膝无力。腰5-骶1（E错）病变对应S1受累，表现为外踝附近及足外侧痛、触觉减退，足跖屈肌力减弱， 踝反射减弱或消失。